视交叉中间部损伤将导致
A. 双眼视野鼻侧半偏盲
B. 双眼视野颞侧半偏盲
C. 双眼视野右侧半偏盲
D. 双眼视野左侧半偏盲
E. 以上都不是

正确答案：B。双眼视野颞侧半偏盲

解析：当视觉传导通路的不同部位受损时，可引起不同的视野缺损： 视网膜损伤引起的视野缺损与损伤的位置和范围有关； 一侧视神经损伤可致该侧眼视野全盲； 视交叉中交叉纤维损伤可致双眼视野颞侧半偏盲（B对）； 双侧视交叉外侧部的不交叉纤维损伤，则双眼视野的鼻侧半偏盲（A错）。